过期妊娠，羊水过少时，胎心电子监护胎心率变化可能是
A. 早期减速
B. 变异减速
C. 周期性胎心率加速
D. 晚期加速
E. 宫缩时晚期减速

正确答案：E。宫缩时晚期减速

解析：过期妊娠，羊水过少时，可导致胎儿严重缺氧，进而发生宫缩时晚期减速（E对）。早期减速（A错），一般发生在第一产程后期，为宫缩时胎头受压引起，不受孕妇体位或吸氧而改变。变异减速（B错），一般认为宫缩时脐带受压兴奋迷走神经引起。晚期加速（D错）原因可能是胎儿躯干局部或脐静脉受压。周期性胎心率加速（C错）为胎动的正常变化。